检查环丙沙星的质量标准，应查阅
A. 《中国国家处方集》
B. 《注射药物手册》
C. 《新编药物学》
D. 《中华人民共和国药典（一部）》
E. 《中华人民共和国药典（二部）》

正确答案：E。《中华人民共和国药典（二部）》

解析：本题考查药典。检查环丙沙星的质量标准，应查阅药典二部正文（E对）。药物的质量检查和质量标准在药典的正文部分。2015年版中国药典分四部出版：一部为中药，二部为化学药，三部为生物制品，四部为总则。